属于右向左分流型先天性心脏病的是
A. 肺动脉瓣狭窄
B. 二尖瓣关闭不全
C. 法洛四联症
D. 主动脉瓣狭窄
E. 室间隔缺损

正确答案：C。法洛四联症

解析：先天性心脏病在临床上根据心脏左、右两侧及大血管之间有无血液分流分为三大类：左向右分流型，右向左分流型和无分流型；其中右向左分流型（紫绀型）为某些原因（如右心室流出道狭窄）致使右心压力增高并超过左心，使血流从右向左分流。或因大动脉起源异常使大量静脉血流入体循环，均可出现持续性紫绀。此型中法洛四联症（C对）和大动脉错位等常见。肺动脉瓣狭窄（A错）和主动脉瓣狭窄（D错）属于无分流型。二尖瓣关闭不全（B错）可见于风湿性或退行性心瓣膜病、二尖瓣脱垂、急性风湿热或运动、发热、贫血等症。室间隔缺损（E错）属于左向右分流型。